下列哪种体位是肛门与直肠检查的错误体位
A. 左侧卧位
B. 俯卧位
C. 蹲位
D. 仰卧位或截石位
E. 肘膝位

正确答案：B。俯卧位

解析：肛门和直肠检查常用视诊和触诊，常可以发现很多重要的临床体征，肛门检查常用的体位有肘膝位（E对）（病人双膝跪于检查床上，两前臂屈曲于胸前，头部及前胸部垫枕，臀部抬高，两膝略分开。是检查肛管最常用的体位。在男性取前列腺液时也取此姿势）、左侧卧位（A对）、仰卧位或截石位（D对）（病人仰卧，双腿放置于腿架上，将臀部移到床边，能最大限度的暴露会阴，多用于肛肠手术和妇科手术）、蹲位（A对）。俯卧位（B错，为本题正确答案）不是肛门与直肠检查的常用体位。